男婴，8个月。腹泻伴呕吐3天，无尿6小时。大便10-15次/天，呈蛋花汤样伴黏液，有腥臭味。查体：T37.8C，表情淡漠，前囟、眼窝明显凹陷，皮肤弹性差，可见花纹，四肢厥冷，双肺呼吸音清，心率120次/分，腹软，无明显压痛。实验室检查：粪镜检偶见白细胞，血钠134mmol/L。患儿输液后出现腹胀，肠鸣音减弱，膝腱反射消失。首先考虑的诊断是
A. 低钾血症
B. 低钙血症
C. 低磷血症
D. 低镁血症
E. 低钠血症

正确答案：A。低钾血症

解析：婴幼儿，腹泻伴呕吐3天，无尿6小时（提示重度脱水），大便10-15次/天，呈蛋花汤样伴黏液，有腥臭味，查体：T37.8℃（正常值为36℃～37℃，提示发热），表情淡漠，前囟、眼窝明显凹陷，皮肤弹性差，可见花纹，四肢厥冷（重度脱水的典型临床表现），双肺呼吸音清，心率120次/分（正常值为60～100次/分，心率增快），腹软，无明显压痛，实验室检查：粪镜检偶见白细胞，血钠134mmol/L（正常值为130～150mmol/L，提示等渗脱水），根据患儿的症状、体征及实验室检查，考虑最可能的诊断为腹泻病伴有重度等渗脱水，患儿输液后出现腹胀，肠鸣音减弱，膝腱反射消失（低钾血症的典型临床表现），首先考虑的诊断是低钾血症（A对），患儿频繁腹泻、呕吐导致消化液丢失过多，从而出现低钾血症，当血钾降低时神经、肌肉兴奋性降低，从而出现上述一系列症状。